男，45岁，右利手。因头痛和言语障碍6月余就诊。头颅MRI显示左侧中央前回底部前方有占位性病变，脑膜瘤可能性大。该患者的言语障碍最可能是
A. 失写
B. 失读
C. 感觉性失语
D. 传导性失语
E. 运动性失语

正确答案：E。运动性失语

解析：患者头痛和语言障碍6月余，颅脑MRI提示脑部左侧中央前回底部有占位性病变，最可能导致Broca区损伤，该区损伤后患者会出现能看懂文字和听懂别人说话，但是自己不会说话，失去了语言的组织能力，称为运动性失语（E对）。失写症（A错）表现为虽能听懂别人说话，能看懂文字，自己也会讲话，但不会书写，多见于额中叶后部受损。失读症（B错）表现为患者看不懂文字，但其视觉并无损害，其他语言活动均健全，多见于角回受损。感觉性失语（C错）表现为患者能讲话及书写，也能看懂文字，但听不懂别人的谈话，因此不能回答别人的问题，多见于颞上回受损。传导性失语（D错）表现为患者对语言的输出和理解都正常，仅是对部分词不能很好的组织或想不起来，多见于弓状束损伤。